女，28岁，诉妊娠4+月，昨搬重物后，腰酸，下坠感，今上午下腹始有阵痛，持续加重，半小时前阴道有流液，量较多，湿透内裤，急诊来院最有助于该诊断的检查是
A. 测宫缩
B. 听胎心
C. 测阴道液体pH
D. 尿hCG定性
E. 血常规

正确答案：C。测阴道液体pH

解析：正常阴道液PH值为4.5～5.5，羊水PH为7.0～7.5，若PH≥6.5，提示胎膜破裂，羊水流入了阴道液中。掌握“自然流产”知识点。